下列各项，五输穴中属“水”的是
A. 少府
B. 大陵
C. 后溪
D. 曲泉
E. 经渠

正确答案：D。曲泉

解析：根据阳井金，阴井木进行配属。阴经的井荥输经合属木火土金水，阳经的井荥输经合属金水木火土。曲泉是肝经的合穴属水（D对）。少府是心经的荥穴属火（A错）。大陵是心包经的输穴属土（B错）。后溪是小肠经的输穴属木（C错）。经渠是肺经的输穴属金（E错）。